某药厂生产的清开灵注射液，其药物组成包括胆酸、珍珠母（粉）、猪去氧胆酸、栀子、水牛角（粉）、板蓝根、黄芩苷、金银花、附加剂为依地酸二钠、硫代硫酸钠、甘油。具有清热解毒、化瘀通络、醒神开窍。附加剂硫代硫酸钠的作用是
A. 抗氧剂
B. 增溶剂
C. 抑菌剂
D. pH调节剂
E. 渗透压调节剂

正确答案：A。抗氧剂

解析：本题考查的是注射剂的附加剂。清开灵注射液的附加剂亚硫酸钠的作用是抗氧剂（A对）。抗氧剂：抗氧剂是一类易被氧化的还原剂。常用抗氧剂有亚硫酸钠、亚硫酸氢钠和焦亚硫酸钠等，一般浓度为0.1%～0.2%。其中亚硫酸钠常用于偏碱性药液，亚硫酸氢钠和焦亚硫酸钠常用于偏酸性药液。增溶剂（B错）：为了提高注射液中药物的溶解度，在保证安全有效的前提下，可考虑加入适量的增溶剂。除另有规定外，供静脉用的注射液，慎用增溶剂；椎管内注射用的注射液，不得添加增溶剂。常用增溶剂有聚山梨酯80、蛋黄卵磷脂、大豆磷脂等；抑菌剂（C错）：多剂量包装的注射液可加适宜的抑菌剂。抑菌剂的用量应能抑制注射液中微生物的生长，在制剂确定处方时，该处方的抑菌效力应符合《中国药典》抑菌效率检查法的规定。常用抑菌剂为0.5%苯酚、0.3%甲酚、0.5%三氯叔丁醇、0.01%硫柳汞等。pH调节剂（D错）：注射液的pH一般应控制在4.0～9.0之间，大剂量输入的注射液pH应接近中性。常用的调节pH的附加剂有盐酸、枸橼酸、氢氧化钠、氢氧化钾、碳酸氢钠、缓冲剂磷酸氢二钠和磷酸二氢钠等。渗透压调节剂（E错）：凡与人体血液、泪液渗透压相同的溶液称为等渗溶液。大量注入低渗溶液会导致溶血，因此大容量注射液应调节渗透压。常用的调节渗透压的附加剂有氯化钠、葡萄糖等。调节方法有冰点降低数据法和氯化钠等渗当量法。